下列关于髋关节结核的叙述，错误的是
A. 儿童多见
B. 早期病变以单纯性骨结核多见
C. 可出现膝关节处疼痛
D. 进行性关节间隙变窄为早期X线征象
E. 4字征阳性

正确答案：B。早期病变以单纯性骨结核多见

解析：髋关节结核多见于儿童（A对），且多为单侧性发病，早期病变以单纯性滑膜结核多见（B错，为本题正确答案）。病人表现为患侧髋关节疼痛，活动后加剧，儿童病人常诉膝关节处疼痛（C对），因而有时易误诊为膝关节疾病。早期X线可表现为进行性关节间隙变窄（D对），“4”字征（E对）、髋关节过伸试验和托马斯征多为阳性。